在工作中欲了解化学药物制剂各剂型的基本要求和常规检查的有关内容，需查阅的是
A. 《中国药典》二部凡例
B. 《中国药典》二部正文
C. 《中国药典》四部正文
D. 《中国药典》四部通则
E. 《临床用药须知》

正确答案：D。《中国药典》四部通则

解析：本题考查《中国药典》。在工作中欲了解化学药物制剂各剂型的基本要求和常规检查的有关内容，需查阅的是《中国药典》四部通则（D对）。通则是对药品的质量指标的检测，包括性状、鉴别、检查与含量测定等涉及的技术方法或指导原则的统一规定，而制剂通则在每种剂型下规定有该剂型的定义、基本要求和常规的检查项目，所以在工作中欲了解化学药物制剂各剂型的基本要求和常规检查的有关内容，需查阅的是《中国药典》四部通则。《中国药典》包括凡例、正文及附录，是药品研制、生产、经营、使用和监督管理等均应遵循的法定依据，所有国家药品标准应当符合中国药典凡例及附录的相关要求。凡例（A错）是对《中国药典》正文、通则与药品质量检定有关的共性问题的统一规定，在《中国药典》各部中列于正文之前。《中国药典》由一部、二部、三部、四部及增补本组成。一部：分类收载药材和饮片、植物油脂和提取物、成方制剂和单味制剂。二部（B错）分为两部分：①收载化学药品、抗生素、生化药品及各类药物制剂（列于原料药之后）；②收载放射性药品制剂。三部：收载生物制品。四部（C错）：收载通则和药用辅料。《临床用药须知》（E错）除汇总每类药品的概述外，还介绍其用途、药理、不良反应、注意事项、药物相互作用、给药说明、用法与用量、制剂与规格等。